女，70岁，风湿性心脏瓣膜病20年。因心悸5天就诊。查体：自动体位，BP150/70mmHg，心率119次/分，心律绝对不齐，心音强弱不等。心电图示：心房颤动。为控制该患者的心室率不宜首选
A. 地高辛
B. 美托洛尔
C. 异搏定
D. 硫氮䓬酮
E. 普罗帕酮

正确答案：E。普罗帕酮

解析：普罗帕酮（E错，为本题正确答案）为ⅠC类抗心律失常药，在房颤治疗中可用于转复并维持窦性心律，但其可能导致室性心律失常，不宜应用于严重器质性心脏病患者（P190）。异搏定（维拉帕米）（C对）和硫氮䓬酮（地尔硫䓬）（D对）均属于非二氢吡啶类钙通道阻滞剂，对心肌具有负性肌力、负性频率和负性传导的作用（九版药理学P188），可用于房颤患者控制心室率。地高辛（A对）和选择性β₁受体拮抗剂美托洛尔（B对）也可用于控制房颤患者的心室率。